下列具有致畸作用的抗癫痫药物是
A. 苯妥英钠
B. 苯巴比妥
C. 卡马西平
D. 地西泮
E. 乙琥胺

正确答案：A。苯妥英钠